属于化学法制备微囊的方法是
A. 单凝聚法
B. 复凝聚法
C. 溶剂-非溶剂法
D. 辐射交联法
E. 喷雾干燥法

正确答案：D。辐射交联法